用于治疗低磷血症的药物是
A. 碳酸钙
B. 三磷酸腺苷
C. 二磷酸果糖
D. 葡萄糖
E. 螺内酯

正确答案：C。二磷酸果糖

解析：本题考查二磷酸果糖。二磷酸果糖（C对）临床用于心肌缺血引起的各种症状，如心绞痛、心肌梗死和心力衰竭，低磷血症。